下列食物中相对含钙高且吸收好的食物是
A. 禽肉
B. 畜肉
C. 蛋类
D. 乳类
E. 菠菜、苋菜等

正确答案：D。乳类